黄柏属于
A. 蓼科
B. 木兰科
C. 芸香科
D. 茄科
E. 马兜铃科

正确答案：C。芸香科

解析：本题考查的是黄柏的来源。黄柏属于芸香科（C对）。黄柏：【来源】为芸香科植物黄皮树的干燥树皮。来源于蓼科（A错）的中药有大黄、虎杖、何首乌、蓼大青叶等。来源于木兰科（B错）的中药有厚朴、辛夷、五味子、南五味子等。来源于茄科（D错）的中药有地骨皮、洋金花、枸杞子、天仙子等。来源于马兜铃科（E错）的中药有马兜铃、细辛等。